含环烯醚萜苷类成分的药材是
A. 吴茱萸
B. 巴豆
C. 栀子
D. 薏苡仁
E. 补骨脂

正确答案：C。栀子

解析：本题考查的是栀子的成分。含环烯醚萜苷类成分的药材是栀子（C对）。栀子中的主要有效成分为栀子苷、京尼平苷和京尼平苷酸等，属于C-4位有取代基的环烯醚萜苷。吴茱萸（A错）含吴茱萸碱，属于色胺吲哚类生物碱。巴豆（B错）含巴豆苷，属于氮苷。补骨脂（E错）含有多种香豆素类成分，包括补骨脂内酯（补骨脂素）、异补骨脂内酯（异补骨脂素）和补骨脂次素等。薏苡仁（D错）的成分，2022年考试指南未明确说明。